从病原体侵入机体到临床症状出现这段时间称为
A. 传染期
B. 潜伏期
C. 隔离期
D. 非传染期
E. 以上都不对

正确答案：B。潜伏期

解析：本题考查潜伏期。从病原体侵入机体到临床症状出现这段时间称为潜伏期（B对ACDE错）。